在十二经脉走向中，足之三阴是
A. 从脏走手
B. 从头走足
C. 从足走胸
D. 从足走腹
E. 从手走头

正确答案：D。从足走腹

解析：本题考查十二经脉走向，属理解内容。手之三阴，从脏走手；手之三阳，从手走头；足之三阳，从头走足；足之三阴，从足走腹，可以明确得知（D对）。